下列各项，入汤剂应后下的药物是
A. 酸枣仁
B. 柏子仁
C. 白豆蔻
D. 郁李仁
E. 桃仁

正确答案：C。白豆蔻

解析：白豆蔻的用量用法为煎服，3～6g，后下（C对）。酸枣仁的用法用量为煎服，10～15g（A错）。柏子仁的用法用量为煎服，3～10g（B错）。郁李仁的用法用量为煎服，6～10g（D错）。桃仁的用法用量为煎服，5～10g（E错）。